下列哪项可能是血管神经性水肿发病的诱因
A. 紧张
B. 食物
C. 劳累
D. 外伤
E. 病毒

正确答案：B。食物

解析：本题考查血管性水肿的病因。血管神经性水肿是一种急性局部反应型的黏膜皮肤水肿，又称巨型荨麻疹，亦称奎英克水肿，是Ⅰ型超敏反应，特点是突然发作的局限性水肿，消退亦较迅速。可能由某些食物如鱼、虾、蟹、蛋类、奶类引起（B对）。药物、感染、情绪激动、寒冷刺激均可成为本病的诱发因素，也可有些是家族性的遗传因素，被认为是常染色体显性遗传病。